人群疾病的自然史研究，可见于下列哪项研究
A. 病例对照研究
B. 实验研究
C. 横断面研究
D. 队列研究
E. 类实验研究

正确答案：D。队列研究

解析：本题考查队列研究的研究目的。队列研究（D对ABCE错）可以观察人群从暴露于某因素后，疾病逐渐发生、发展，直至结局的全过程，可用于研究疾病的自然史。